一肺炎合并休克患者，治疗后血压96/66mmHg，脉搏96次/分，中心静脉压14cmH₂O，尿比重1.014，尿量15ml/小时，尿钠40mmol/L，肺毛细血管楔压12mmHg，可能为
A. 电解质紊乱
B. 心衰
C. 血容量不足
D. 急性肾功衰竭
E. 休克基本纠正，无合并症

正确答案：D。急性肾功衰竭

解析：肺炎合并休克患者，治疗后治疗后血压96/66mmHg（正常值为90～140/60～90mmHg），脉搏96次/分（60～100次/分），中心静脉压14cmH₂O（5～12cmH₂O，提示中心静脉压升高），尿比重1.014（<1.015，提示低比重尿），尿量15ml/小时（<17ml/h，提示尿量减少），尿钠40mmol/L，肺毛细血管楔压12mmHg（左心衰时>18mmHg），该患者少尿、低渗透尿、低比重尿，可能为急性肾功能衰竭（D对），该患者血压尚可、肺毛细血管楔压正常，故心衰错误（B错），中心静脉压升高说明静脉血多，故血容量不足错误（C错），题中所给数值并不能说明电解质紊乱（A错）。